Kennedy第二类的设计中游离端侧缺牙两个以上者，对侧也有缺牙的情况下的说法正确的是
A. 形成面式卡环线
B. 在缺隙两侧的基牙上放置卡环
C. 可避免游离端的摆动
D. 可避免游离端的旋转和翘动
E. 以上说法均正确

正确答案：E。以上说法均正确

解析：Kennedy第二类的设计要点：第二类缺失义齿的特点及设计要点均与第一类基本相同。不同点是第二类为单侧游离缺失，义齿不易平衡、稳定，必须双侧设计，在对侧设计间接固位体，用大连接体或鞍基连接，以分散（牙合）力，获得义齿的平衡、稳定和固位。游离端侧缺牙两个以上者，在游离端基牙上放置卡环，用大连接体连到牙弓的对侧，在对侧牙弓上选两个基牙放置卡环。如对侧也有缺牙，则可在缺隙两侧的基牙上放置卡环，形成面式卡环线，可避免游离端的摆动、旋转和翘动。掌握“局部义齿的设计”知识点。